下列大豆及其制品中消化率最低的是
A. 炒黄豆
B. 豆浆
C. 豆腐
D. 腐竹
E. 豆豉

正确答案：A。炒黄豆